关于唇癌的描述错误的是
A. 唇癌主要是鳞癌
B. 唇癌多发于下唇
C. 唇癌一般以手术治疗为主
D. 下唇癌常向颏下及下颌下淋巴结转移
E. 唇癌较其他口腔癌易发生颈淋巴结转移

正确答案：E。唇癌较其他口腔癌易发生颈淋巴结转移

解析：本题考查唇癌。关于唇癌的描述错误的是唇癌较其他口腔癌易发生颈淋巴结转移（E错，为本题的正确答案）。唇癌是发生唇红黏膜的癌。唇红部发生的癌几乎都是鳞癌（A对）。上下唇均可发生唇癌，下唇比较常见（B对），多见于下唇中外1/3间的唇红缘部的黏膜。早期唇癌无论采用手术、放射治疗、激光治疗或低温治疗均有较好的疗效，晚期多采用手术治疗（C对）。上唇癌转移较下唇癌多见，下唇癌常向颏下及下颌下淋巴结转移（D对）；唇癌较其他口腔癌较少发生颈淋巴转移，且转移时间较迟。